女，22岁，因多关节疼痛2个月就诊，近1周出现双手指间关节及掌指关节肿胀，晨僵30min。血白细胞3.2×10⁹/L，血小板83×10⁹/L；24小时尿蛋白定量1.9g；血沉48mm/第1小时，血抗核抗体阳性；补体C3轻度下降。最可能的诊断是
A. 类风湿关节炎
B. 骨关节炎
C. 系统性红斑狼疮
D. 原发性干燥综合征
E. 系统性血管炎

正确答案：C。系统性红斑狼疮

解析：年轻女性患者（系统性红斑狼疮SLE好发人群），多关节疼痛2个月，近1周出现双手指间关节及掌指关节肿胀、晨僵半小时（SLE肌肉关节表现）；血白细胞降低、血小板降低（SLE血液系统表现）；尿蛋白升高（SLE肾脏受累表现）；血沉加快，血抗核抗体阳性（见于几乎所有SLE患者），补体C3轻度下降，应考虑诊断为系统性红斑狼疮（C对）。类风湿关节炎（A错）常为对称性、持续性关节疼痛，以腕、掌指及近端指间关节最常见，其晨僵持续时间超过1小时意义才较大；很少出现肾脏受累；自身抗体主要为类风湿因子和抗角蛋白抗体谱阳性；患者血清补体多升高（P808）。骨关节炎（B错）主要见于中老年人，以膝、髋及脊柱等承重关节受累为主，晨僵时间短，一般不超过30分钟，一般无抗核抗体阳性、无补体改变、无血象改变（P857）。原发性干燥综合征（D错）临床上主要表现为干燥性角结膜炎，口腔干燥症等局部症状（P829）。系统性血管炎（E错）常见的共同的临床表现包括全身症状如乏力、发热、体重减轻、各种皮疹、关节及肌肉疼痛等，常出现ANCA阳性而ANA为阴性（P835）。